在细胞介导的抗肿瘤免疫中，下述正确的是
A. CD8⁺CTL是抗肿瘤免疫的主要效应细胞
B. CTL杀伤肿瘤细胞不受MHC限制
C. 用巨噬细胞抑制剂可抑制机体内肿瘤生长
D. 中性粒细胞可特异的杀伤人体内多种肿瘤
E. NK细胞通过表面的IgE Fc段受体与瘤细胞上的抗体结合发挥ADCC效应

正确答案：A。CD8⁺CTL是抗肿瘤免疫的主要效应细胞